治肺热咳嗽，可选用
A. 栀子
B. 黄芩
C. 鱼腥草
D. 生地黄
E. 地骨皮

正确答案：B、C、E。黄芩；鱼腥草；地骨皮

解析：本题考查的是黄芩、鱼腥草与地骨皮的主治病证。治肺热咳嗽，可选用黄芩（B对）、鱼腥草（C对）与地骨皮（E对）。黄芩：【主治病证】（1）湿温，暑湿，湿热胸闷、黄疸、泻痢、淋痛、疮疹。（2）热病烦渴，肺热咳喘，少阳寒热，咽痛，目赤，火毒痈肿。（3）血热之吐血、咳血、衄血、便血、崩漏。（4）胎热之胎动不安。鱼腥草：【主治病证】（1）肺痈咳吐脓血，肺热咳嗽痰稠。（2）热毒疮疡，湿热泻痢。（3）热淋涩痛。地骨皮：【主治病证】（1）阴虚发热，有汗骨蒸，小儿疳热。（2）血热之吐血、衄血、尿血。（3）肺热咳嗽。（4）内热消渴。栀子（A错）：【主治病证】（1）热病心烦、郁闷、躁扰不宁。（2）湿热黄疸，热淋，血淋。（3）血热吐血、衄血、尿血。（4）热毒疮肿，跌打肿痛。生地黄（D错）：【主治病证】（1）温病热入营血证。（2）血热之吐血、衄血、尿血、崩漏下血。（3）热病后期伤阴，阴虚发热，内热消渴。（4）阴虚肠燥便秘。